心经的郄穴是
A. 少府
B. 神门
C. 阴郄
D. 灵道
E. 通里

正确答案：C。阴郄

解析：该题考查十六经脉的郄穴。心经的郄穴是阴郄（C对），少府为心经的荥穴（A错），神门为心经的输穴（B错），灵道为心经的经穴（D错），通里为心经的络穴（E错）。